根据《药品广告审查办法》，药品监督管理部门审批药品广告的时限为
A. 5日
B. 10日
C. 15日
D. 20日
E. 30日

正确答案：B。10日

解析：本题考查药品广告的审批。根据《药品广告审查办法》，药品监督管理部门审批药品广告的时限为10日（B对）。广告审查机关应当对申请人提交的材料进行审查，自受理之日起十个工作日内完成审查工作。